与心、肾的生理功能密切相关的是
A. 呼吸运动
B. 藏泄互用
C. 气的生成
D. 精血互生
E. 血液运行

正确答案：D。精血互生

解析：本题考查心与肾的关系。与心、肾的生理功能密切相关的是精血互生（D对）。心与肾的关系，主要表现在心肾阴阳水火既济与心血肾精之间的依存关系。精血互生：心主血，肾藏精，血化为精，精能生血，这种精血互生关系，体现了心肾之间的相关性。肺与肾的关系主要表现于津液代谢、呼吸运动、阴液互滋三个方面。呼吸运动：肺主呼吸，肾主纳气，肺的呼吸功能需要肾的纳气作用来协助。肺从自然界吸入的清气，须在肺气肃降的作用下，下归于肾，由肾摄纳，才能为人体所用。若肾中精气充盛，摄纳功能正常，则可见呼吸深沉平稳。故有“肺为气之主，肾为气之根”之说。肝与肾的关系，称“肝肾同源”或“乙癸同源”（以天干配五行，肝属乙木，肾属癸水，故称），主要表现于精血同源、藏泄互用（B错）及阴阳互资等方面。肺与脾的关系，主要表现在气的生成和津液的输布代谢两个方面。气的生成（C错）：肺所吸入的清气和脾运化而生成的水谷精气，是组成宗气的主要物质。因此，肺的呼吸功能和脾的运化功能是否强健，与气的盛衰密切相关。心与脾的关系，主要表现在血液的生成和运行两方面。1.血液生成：脾运化水谷精微，以生化血液。脾气旺盛，则血之生化功能正常，血液充盛心有所主。心主血，营气和津液化赤为血。心之阳气可以温养脾土，使脾阳不衰，保证了脾生化血液之正常。2.血液运行（E错）：心气推动血液循环，脾气统摄血液行于脉中，推动力和固摄力的协调平衡，从而维持血液正常循行。